用于治疗抑郁症的药物是
A. 氯丙嗪
B. 丙咪嗪
C. 司来吉兰
D. 哌替啶
E. 硫酸锂

正确答案：B。丙咪嗪

解析：本题考查丙咪嗪。用于治疗抑郁症的药物是丙咪嗪（B对）。丙咪嗪为三环类抗抑郁药，主要通过抑制突触前膜对5-HT及去甲肾上腺素的再摄取，使突触间隙的去甲肾上腺素和5-HT浓度升高，促进突触传递功能而发挥抗抑郁作用。氯丙嗪（A错）为抗精神病药。司来吉兰（C错）为抗帕金森病药。哌替啶（D错）为镇痛药。硫酸锂（E错）为抗躁狂药。